制剂中药物的化学降解途径不包括
A. 水解
B. 氧化
C. 异构化
D. 结晶
E. 脱羧

正确答案：D。结晶

解析：本题考查药物降解途径。制剂中药物的化学降解途径不包括结晶（D错，为本题正确答案）。结晶属于物理变化，不属于化学降解途径。药物由于化学结构的不同，外界环境不同，可发生不同类型的降解反应，水解（A对）和氧化（B对）是药物降解的两个主要途径。其他如异构化（C对）、聚合、脱羧（E对）等反应，在某些药物中也有发生。